某患者血氧检查结果是：血氧容量20ml/dl,动脉血氧含量15ml/dl,动脉血氧分压6.7kPa(50mmHg),动－静脉氧含量差4ml/dl。其缺氧类型为
A. 乏氧性缺氧
B. 血液性缺氧
C. 循环性缺氧
D. 组织性缺氧
E. 混合性缺氧

正确答案：A。乏氧性缺氧

解析：正常成人的血氧含量为20ml/dl，动脉血氧含量(Ca02)约为19ml/dl，动脉血氧分压(Pa02)约为lOOmmHg，动－静脉氧含量差约为5ml/dl，而该患者血氧检查结果与正常值相比，血氧容量正常、动脉血氧含量降低、动脉血氧分压降低、动-静脉氧含量差降低，这些都符合乏氧性缺氧（A对）的血氧变化特点。